患者，女，10个月，发热，伴间断呕吐10天。体检：精神可，较兴奋，方颅。脑脊液：外观毛玻璃样，白细胞30×10⁶/L，中性粒细胞0.60，清蛋白0.43g/L，氯化物108mmol/L，糖2.5mmol/L。可能的诊断是
A. 化脓性脑膜炎
B. 结核性脑膜炎
C. 病毒性脑炎
D. 流行性脑炎
E. 感染中毒性脑病

正确答案：B。结核性脑膜炎

解析：患儿，女，10个月（结核性脑膜炎多见于3岁以内婴幼儿），发热、呕吐（提示颅内压增高），较兴奋（结核性脑膜炎的前期表现）。脑脊液外观毛玻璃样（结核性脑膜炎的脑脊液特点），白细胞30×10⁶/L（＜500×10⁶/L），中性粒细胞0.60，清蛋白0.43g/L，氯化物108mmol/L、糖2.5mmol/L（糖和氯化物均降低是结核性脑膜炎的典型表现），综合患儿的病史、症状、体征，考虑结核性脑膜炎（B对）。化脓性脑膜炎（A错）脑脊液外观混浊似米汤样，白细胞显著增多，≥1000×10⁶/L，分类以中性粒细胞为主。糖含量明显降低，蛋白质含量显著增高。病毒性脑膜炎（C错）脑脊液较清亮，白细胞数为0至数百×10⁶/L，分类以淋巴细胞为主，糖含量正常。流行性脑膜炎（D错）常有接触史，脑脊液表现与化脓性脑膜炎类似。感染中毒性脑病（E错）常有原发疾病，脑脊液除压力增高外，糖、蛋白质、氯化物含量均正常。